不需要医生处方可由病人自行在药房、药店选择使用的药品
A. 处方药
B. 非处方药
C. 两者都是
D. 两者都不是

正确答案：B。非处方药

解析：本题考查非处方药。不需要医生处方可由病人自行在药房、药店选择使用的药品是非处方药（B对）。非处方药是指由国家药品监督管理局公布的，不需要凭执业医师和执业助理医师处方，消费者可以自行判断、购买和使用的药品。处方药（A错）是指凭执业医师和执业助理医师处方方可购买、调配和使用的药品。